计算暴发性肝炎，反映某单位的医疗水平常用的指标
A. 罹患率
B. 患病率
C. 发病率
D. 病死率
E. 感染率

正确答案：D。病死率

解析：本题考查病死率的应用。病死率（D对ABCE错）表示确诊某病者的死亡概率，它可反映疾病的严重程度，也可反映医疗水平和诊治能力，常用于急性传染病。反映暴发性肝炎医疗水平的指标可选择病死率。